下述关于翼腭间隙的叙述中哪项是错误的
A. 位于眶尖下方
B. 前界为上颌骨体
C. 后界为蝶骨翼突
D. 上为蝶骨大翼
E. 内以鼻甲为界

正确答案：E。内以鼻甲为界

解析：翼腭间隙（翼腭窝）：位于眶尖的下方、颞下窝的内侧。前界为上颌骨体部，后界为蝶骨翼突，上为蝶骨大翼，内以腭骨垂直板为界。掌握“面侧深区及颌面部各间隙的境界”知识点。